骨折病人发生休克的主要原因是
A. 肿胀
B. 出血
C. 疼痛
D. 惊吓
E. 发热

正确答案：B。出血

解析：骨折病人发生休克的主要原因是出血（B对），特别是骨盆骨折、股骨骨折和多发性骨折，骨盆骨折500-5000ml，股骨骨折200-2000ml。肿胀（A错）、疼痛（C错）为骨折的一般局部表现，较少引起全身症状，一般不会引起休克。发热（E错）为骨折的全身表现，不是导致骨折休克的主要原因。